拟除虫菊酯类农药的缺点是
A. 高残留性
B. 低效性
C. 高抗药性
D. 高蓄积性
E. 高毒性

正确答案：C。高抗药性

解析：本题考查拟除虫菊酯类农药的缺点。拟除虫菊酯类农药是一类模拟除虫菊所含的天然除虫菊素的化学结构合成的仿生农药，主要用作杀虫剂和杀螨剂。该类农药的缺点是高抗药性（C对ABDE错），即昆虫在较短时间内可对其产生抗药性而使其杀虫活性降低甚至完全丧失。